患者，女，36岁，已婚。近3个月来，月经提前6〜7天，量少、色红，每于经期鼻衄，血量少、色红，潮热咳嗽，两颧潮红，咽干，口渴，舌红苔花剥，脉细数，应引血下行。其治法是
A. 滋阴清热
B. 清热凉血
C. 疏肝清热
D. 滋肾平肝
E. 滋肾润肺

正确答案：E。滋肾润肺

解析：该患者每于经期鼻衄，血量少，故诊断为经行吐衄。月经提前6~7天，量少，色红为阴虚虚火内炽，热扰冲任，经血妄行，阴虚则血少所致。虚火上炎，虚火损伤肺络，故血上溢而发生鼻衄，阴虚则血量少，色红。阴虚内热，故潮热咳嗽，两颧潮红，虚火灼伤肺津，故咽干、口渴。舌红，苔花剥，脉细数均为阴虚内热之象，故辨为肺肾阴虚证。治宜滋阴养肺。病证与肺肾有关，滋肾润肺为肺肾阴虚的治法（E对）。